女，24岁。近日发现左膝关节疼痛，行走困难，休息缓解，自觉左小腿上端内侧似有肿块，压痛。查体：左膝关节活动稍受限，胫骨上端内侧肿胀，压痛。X线摄片见左胫骨上端内侧有一肥皂泡样阴影，膨胀性生长。本例适当的治疗方法是
A. 休息、营养
B. 广谱抗生素治疗
C. 手术治疗
D. 抗结核治疗
E. 物理治疗

正确答案：C。手术治疗

解析：青年女性患者（骨巨细胞瘤青年女性略多），近日发现左膝关节疼痛，行走困难，休息缓解，自觉左小腿上端内侧似有肿块（骨巨细胞瘤好发部位为长骨干骺端和椎体），查体：左膝关节活动稍受限，胫骨上端内侧肿胀，压痛（骨巨细胞瘤局部肿块压之有乒乓球样感觉和压痛，病变的关节活动受限）。X线摄片见左胫骨上端内侧有一肥皂泡样阴影，膨胀性生长（骨巨细胞瘤的典型的X线特征）。综合患者的年龄、性别、临床表现及影像学检查可诊断为骨巨细胞瘤。骨巨细胞瘤为交界性肿瘤，以手术治疗（C对）为主，采用病灶刮除术加灭活处理，再植入自体或异体骨或骨水泥，但易复发。休息、营养（A错）为一般性治疗措施。骨巨细胞瘤不是细菌感染性疾病，无需使用广谱抗生素（B错）及抗结核药物（D错）。物理治疗（E错）对骨巨细胞的治疗价值不大。